冠状窦的叙述,不正确的是
A. 位于心膈面、右心房和右心室之间的冠状沟内
B. 左端有起源于前室间沟的心大静脉注入
C. 右端有起源于后室间沟的心中静脉注入
D. 心小静脉注入冠状窦的右端
E. 借冠状窦口注入右心房

正确答案：A。位于心膈面、右心房和右心室之间的冠状沟内

解析：冠状窦位于心膈面，左心房（A错，为本题正确答案）与左心室之间的冠状沟内。左端有起源于前室间沟的心大静脉注入（B对）。右端有起源于后室间沟的心中静脉注入（C对）。心小静脉注入冠状窦的右端或心中静脉（D对）。借冠状窦口注入右心房（E对）。